胆固醇含量最高的部位是
A. 脑
B. 舌
C. 肝脏
D. 瘦肉
E. 肥肉

正确答案：A。脑